患儿，10岁。发热，头痛一天，频繁抽搐，昏迷5小时。血压测不到，右侧瞳孔散大，对光反射消失。此时不宜做的措施是
A. 扩容、解痉
B. 应用抗生素
C. 脑脊液检查
D. 血液生化
E. 血培养

正确答案：C。脑脊液检查

解析：患儿发热、头痛、抽搐、意识障碍，且一侧瞳孔散大、对光反射消失，考虑有颅内病变，颅内压增高。颅内压增高时不宜做脑脊液检查，因为腰穿可能会诱发脑疝（C错，为本题正确答案）。扩容，解痉（Ａ对）、应用抗生素（Ｂ对）、血液生化（Ｄ对）、血培养（Ｅ对）均可常规应用。